DNA在加热变性时，其分子的变化是
A. 磷酸二酯键断裂
B. 形成超螺旋
C. 碱基丢失，螺旋减少
D. 形成左手螺旋
E. 双螺旋解链

正确答案：E。双螺旋解链

解析：本题考查DNA变性。DNA在加热变性时，其分子的变化是双螺旋解链（E对）。某些理化因素（温度、PH、离子强度等）会导致DNA双链互补碱基对之间的氢键发生断裂，使DNA双链解离为单链，这种现象称为DNA变性。